蜈蚣药材的性状特征有
A. 全体共22个环节
B. 头部和躯干第一背板暗红色或红褐色
C. 第二背板及以后均为棕绿色或墨绿色
D. 步足棕绿色或墨绿色
E. 有刺鼻臭气，味辛而微咸

正确答案：A、B、C、E。全体共22个环节；头部和躯干第一背板暗红色或红褐色；第二背板及以后均为棕绿色或墨绿色；有刺鼻臭气，味辛而微咸

解析：本题考查的是蜈蚣药材的性状鉴别。蜈蚣药材的性状特征有全体共22个环节（A对）、头部和躯干第一背板暗红色或红褐色（B对）、第二背板及以后均为棕绿色或墨绿色（C对）与有刺鼻臭气，味辛而微咸（E对）。蜈蚣：【性状鉴别】药材呈扁平长条形。由头部和躯干部组成，全体共22个环节。头部暗红色或红褐色，略有光泽，有头板覆盖，头板近圆形，前端稍突出，两侧贴有颚肢1对，前端两侧有触角1对。躯干部第1背板与头板同色，其余20个背板为棕绿色或墨绿色，具光泽，自第4背板至第20背板常有2条纵沟线；腹部淡黄色或棕黄色，皱缩；自第2节起，每体节两侧有步足1对，步足黄色或红褐色（D错），偶有黄白色，呈弯钩形，最末一对步足尾状，故又称尾足，易脱落。质脆，断面有裂隙。气微腥，并有特殊刺鼻的臭气，味辛、微咸。